胸痹的典型症状是
A. 胸闷气短
B. 喘息咳唾，胸背痛，短气
C. 胸中刺痛
D. 咳喘，不能平卧
E. 心痛彻背，背痛彻心

正确答案：B。喘息咳唾，胸背痛，短气

解析：胸痹主症为“喘息咳唾，胸背痛，短气”，而“胸背痛，短气”是辨证的关键（B对）。寸候上焦，寸口脉沉而迟为胸阳不振；关候中焦，关上小紧数，为寒饮内停、正邪交争之脉象。由于胸阳不振、肺失肃降，故喘息咳唾，短气；痰浊阻滞，胸阳不宣，心脉痹阻。故胸背痛。治宜通阳宣痹，用括楼薤白白酒汤治疗。